对解热镇痛抗炎药的正确叙述是
A. 对各种疼痛都有效
B. 镇痛的作用部位主要在中枢
C. 对各种炎症都有效
D. 解热、镇痛和抗炎作用与抑制PG合成有关
E. 抑制缓激肽的生物合成

正确答案：D。解热、镇痛和抗炎作用与抑制PG合成有关